《内经》关于命门的论点是
A. 左肾右命门说
B. 两肾总号命门说
C. "七节之旁，中有小心"说
D. "命门者，目也"说
E. 命门为"水火之宅"说

正确答案：D。"命门者，目也"说

解析：《内经》“太阳根于至阴，结于命门。命门者，目也”（D对）。《难经·三十九难》：“肾两者，非皆肾也，其左为肾，右为命门”（A错）。《医学正传·医学或问》：“两肾总号为命门”（B错）。“七节之旁，中有小心”（C错）为赵献可《医贯》引用《内经》中原文。命门为“水火之宅”（E错），出自《景岳全书》。